男，26岁，5天来鼻及牙龈出血，皮肤瘀斑。血红蛋白55g/L，白细胞10.0×10⁹/L，血小板16×10⁹/L。骨髓增生极度活跃，绝大多数细胞呈清一色，胞浆内有大小不等颗粒及成堆Auer小体，过氧化酶染色强阳性。临床最容易出现的情况是
A. 巨脾
B. DIC
C. 严重感染
D. 中枢神经系统受侵犯
E. 骨髓移植

正确答案：B。DIC

解析：患者诊断为急性早幼粒细胞白血病，急性早幼粒细胞白血病易并发凝血异常引起DIC（弥散性血管内凝血）（B对）。巨脾（P577）（A错）常见于慢性粒细胞白血病；严重感染（C错）可见于各型白血病；中枢神经系统受侵犯（P571）（D错）常见于急性淋巴细胞白血病；齿龈肿胀（P571）（E错）常见于急性粒-单核细胞白血病、急性单核细胞白血病。